构成视束的细胞是
A. 视锥细胞
B. 视杆细胞
C. 双极细胞
D. 神经节细胞
E. 视上核内的细胞

正确答案：D。神经节细胞

解析：构成视束的细胞是神经节细胞（D对）。视束参与构成视觉传导通路。视觉传导通路中，眼球视网膜神经部外层的视锥细胞（A错）和视杆细胞（B错）为光感受器细胞，中层的双极细胞（C错）为第1级神经元，内层的节细胞为第2级神经元，其轴突在视神经盘处汇集成视神经。